主要用于耐药金葡菌感染的半合成青霉素
A. 青霉素V
B. 苯唑西林
C. 替卡西林
D. 哌拉西林
E. 舒巴坦

正确答案：B。苯唑西林